癫痫中应用PET（正电子发射计算机体层显像）检查的重要目的是
A. 鉴别癫痫发作与假性癫痫
B. 癫痫发作形式分类
C. 鉴别原发和继发性癫痫
D. 指导药物的选择应用
E. 癲痫病灶定位

正确答案：E。癲痫病灶定位

解析：癫痫是多种原因导致的脑部神经元高度同步化异常放电所致的临床综合征，临床表现具有发作性、短暂性、重复性和刻板性的特点。应用PET（正电子发射计算机体层显像）检查的重要目的是辅助癫痫病灶定位（E对）。鉴别癫痫发作与假性癫痫（A错）主要通过脑电图、瞳孔表现和治疗效果等来鉴别。癫痫发作形式分类（B错）是根据癫痫发作时的临床表现和脑电图特征进行分类的（P299）。鉴别原发和继发性癫痫（C错）是根据有无明确的中枢神经系统结构损害或功能异常来判断。指导药物的选择应用（D错）是根据癫痫发作类型、癫痫及癫痫综合征类型选药。